某女，35岁。症见咳嗽痰多、胸脘胀闷、恶心呕吐。治当燥湿化痰、理气和胃，宜选用的中成药是
A. 礞石滚痰丸
B. 半夏天麻丸
C. 二陈丸
D. 橘贝半夏颗粒
E. 复方鲜竹沥液

正确答案：C。二陈丸

解析：本题考查二陈丸的主治。治当燥湿化痰、理气和胃，宜选用的中成药是二陈丸（C对）。二陈丸【主治】痰湿停滞导致的咳嗽痰多、胸脘胀闷、恶心呕吐。礞石滚痰丸（A错）【主治】痰火扰心所致的癫狂惊悸，或喘咳痰稠、大便秘结。半夏天麻丸（B错）【主治】脾虚湿盛、痰浊内阻所致的眩晕、头痛、如蒙如裹、胸脘满闷。橘贝半夏颗粒（D错）【主治】痰气阻肺，咳嗽痰多、胸闷气急。复方鲜竹沥液（E错）【主治】痰热咳嗽，痰黄黏稠。